农药被吸收进入人体后短时间内以在（）的浓度最高
A. 肺
B. 脑
C. 肝
D. 肾

正确答案：C。肝

解析：本题考查农药在体内的蓄积。有机磷农药可经胃肠道、呼吸道以及完好的皮肤或黏膜吸收。经呼吸道或胃肠道进入人体时，吸收较为迅速而完全。皮肤吸收是急性职业性中毒的主要途径。吸收后迅速随血液及淋巴循环分布到全身各器官组织，其中以肝脏（C对ABD错）含最最高，肾、肺、脾次之。